导致上颌全口义齿在静止状态时固位良好，但说话和大张口时易脱落的原因不包括
A. 基托边缘过长
B. 系带缓冲不足
C. 人工牙排列位置不当
D. 磨光面外形差
E. 基托不密合

正确答案：E。基托不密合

解析：本题考查全口义齿固位不良的情况及原因。导致上颌全口义齿在静止状态时固位良好，但说话和大张口时易脱落的原因不包括基托不密合（E错，为本题的正确答案）。当口腔处于休息状态时，义齿固位尚好。但张口、说话、打呵欠时义齿易脱位。这是由于基托边缘过长（A对）、过厚，唇、颊、舌系带区基托边缘缓冲不够（B对），人工牙排列位置过于偏牙槽嵴的唇颊侧或舌侧（C对），义齿磨光面外形不好（E对）等原因，影响周围系带和肌肉的功能活动造成的。对于基托边缘或磨光面形态造成的固位不良，可通过磨改基托来解决。人工牙排列位置异常者，应重新排牙或重新制作义齿。